慢性阻塞性肺疾病的体征不包括
A. 呼吸音减弱
B. 支气管呼吸音
C. 心音遥远
D. 桶状胸
E. 呼气相延长

正确答案：B。支气管呼吸音

解析：慢性阻塞性肺疾病是持续气流受限致肺通气功能障碍，患者呼气相延长（E对），视诊胸廓前后径增大，肋间隙增宽，剑突下胸骨下角增宽，称为桶状胸（D对）。病理改变主要表现为慢性支气管炎及肺气肿的病理变化，肺部积气时听诊呼吸音减弱（A对），心音遥远（C对）。支气管呼吸音常见于肺组织实变、压迫性肺不张、肺内出现空腔等病变（B错，为本题正确答案）。